临床上用于判断肺通气功能的较好指标是
A. 补吸气量/用力肺活量
B. 潮气量/肺活量
C. 无效腔量/潮气量
D. 用力呼气量/用力肺活量
E. 潮气量/功能余气量

正确答案：D。用力呼气量/用力肺活量

解析：临床上通常通过判断肺通气功能来大致鉴别阻塞性肺通气障碍还是限制性肺通气功能障碍，良好的指标有助于临床鉴别。用力呼气量/用力肺活量（D对）是判断肺通气功能的较好指标。其中以FEV1/FVC的价值最大，具有重要意义。补吸气量/用力肺活量（A错）、潮气量/肺活量（B错）、无效腔量/潮气量（C错）、潮气量/功能余气量（E错）也是用来判断肺通气功能的指标，但相对于FEV/FVC，没有那么敏感。